女性，24岁。服务业人员，未婚，不否认有性交行为，半月前躯干，四肢，双手掌跖出现红斑，无痒痛感觉，查躯干，四肢可见玫瑰色椭圆形斑迹，对称分布，掌跖部可见黄豆大小铜红色领圈样脱肩，患者最大可能是
A. 玫瑰疱疹
B. 梅毒
C. 红斑狼疮
D. 麻疹
E. 结节性红斑

正确答案：B。梅毒

解析：青年女性患者，半月前躯干、四肢、双手掌跖出现红斑，无痒痛感觉。查体见四肢出现瑰色椭圆形斑迹，掌跖部出现黄豆大小铜红色领圈样脱肩，此为梅毒疹的典型表现，又因患者不否认有性交行为，考虑诊断为梅毒（B对）。玫瑰疱疹（A错）是一种皮肤发炎性皮疹，不是性传播疾病，约40%～50%的患者会有轻微的搔痒感。红斑狼疮（C错）的典型表现为面部碟形红斑，不是性传播疾病。麻疹（D错）是一种儿童最常见的急性呼吸道传染病，其主要临床表现为发热、流涕、咳嗽等，可出现灰白色的麻疹黏膜斑。结节性红斑（E错）是一种主要累及皮下脂肪组织的急性炎症性疾病，常见于小腿伸侧，有疼痛感。